慢性活动性胃炎最主要的病因是
A. 饮食和环境因素
B. 自身免疫
C. 幽门螺杆菌感染
D. 药物
E. 应激

正确答案：C。幽门螺杆菌感染

解析：慢性活动性胃炎最主要的病因是幽门螺杆菌感染（C对），其他常见病因有十二指肠-胃反流、自身免疫（B错）、年龄因素和胃黏膜营养因子缺乏等。饮食和环境因素（A错）、药物（D错）、应激（E错）均为急性胃炎的常见病因。